吸入性肺脓肿最常见的病原菌是
A. 肺炎克雷伯杆菌
B. 肺炎球菌
C. 大肠杆菌
D. 葡萄球菌
E. 厌氧菌

正确答案：E。厌氧菌

解析：吸入性肺脓肿，是肺脓肿最常见的一种类型。当昏迷、醉酒、药物过量、癫痫、脑血管意外时，或由于受寒、极度疲劳等诱因，全身免疫力与呼吸道防御功能降低，误吸入含病原菌的各种污染物而致病，如口咽分泌物等，其中厌氧菌占90%以上（E对）。肺炎克雷伯杆菌（A错）可导致继发性肺脓肿。葡萄球菌（D错）、肺炎球菌（B错）可导致血源性肺脓肿。